男，45岁。进行性少尿4天。既往体健。查体：BP160/90mmHg，心率120次/分，双下肢水肿。血BUN18.9mmol/L，Scr655.6μmol/L。动脉血气分析pH7.31，PaO₂65mmHg，PaCO₂33mmHg，BE⁻8.5mmol/L。急需采取的最主要治疗措施是
A. 透析治疗
B. 利尿治疗
C. 降压治疗
D. 口服泼尼松
E. 纠正酸中毒

正确答案：A。透析治疗

解析：患者中年男性，既往体健，进行性少尿4天，Scr655.6umol/L（肾功能衰竭期：血清肌酐为451～707umol/L），BUN18.9mmol/L（正常值3.1～7.1mmol/L），应考虑患者为急性肾衰。查体示患者2级高血压、心率增快，及双下肢水肿，考虑为水钠潴留导致体循环及肺循环容量负荷过重导致。动脉血气分析PH7.31（正常值7.35～7.45）（提示患者存在酸中毒），PaO₂65mmHg（正常值80～100mmHg），PaCO₂33mmHg（正常值35～45mmHg），BE-8.5mmol/L（正常值-3～+3mmol/L），综上，患者存在酸中毒，但血气分析提示患者出现呼吸性碱中毒，应为急性肾衰竭导致的代谢性酸中毒并呼吸性碱中毒。由上可知，患者的原发病为急性肾衰。急需采取的最主要治疗措施是透析治疗（A对），以此来清除毒素及过多的水分、纠正代谢性酸中毒。利尿治疗（B错）、降压治疗（C错）、纠正酸中毒（E错）分别只能起到降低容量负荷、降压及纠酸的目的，其治疗效果单一且不如透析治疗有效，不适合患者目前急救。口服泼尼松（D错）较少用于急性肾衰患者的治疗中。